当事人对医疗事故鉴定结论不服，提出再次鉴定的申请应在首次鉴定结论之日起
A. 10日内
B. 15日内
C. 20日内
D. 25日内
E. 30日内

正确答案：B。15日内

解析：当事人对首次医疗事故技术鉴定结论不服的，可以自收到首次鉴定结论之日起15日内向医疗机构所在地卫生行政部门提出再次鉴定的申请。掌握“医疗事故的技术鉴定”知识点。